重复作业的特点为
A. 参与作业的肌群少，收缩频率高
B. 参与作业的肌群多，收缩频率低
C. 参与作业的肌群多，收缩频率高
D. 参与作业的肌群少，收缩幅度大
E. 参与作业的肌群多，收缩幅度少

正确答案：A。参与作业的肌群少，收缩频率高